可与碘化铋钾生成黄色至橘红色沉淀的是
A. 香豆素
B. 蒽醌
C. 黄酮
D. 皂苷
E. 生物碱

正确答案：E。生物碱

解析：本题考查的是生物碱的沉淀反应。可与碘化铋钾生成黄色至橘红色沉淀的是生物碱（E对）。大多数生物碱在酸水或稀醇中与某些试剂反应生成难溶于水的络合物或复盐，这一反应称为生物碱沉淀反应，这些试剂称为生物碱沉淀试剂。常用的生物碱沉淀试剂有碘化铋钾试剂、碘化汞钾试剂、碘-碘化钾试剂、硅钨酸试剂、饱和苦味酸试剂、雷氏铵盐试剂等。生物碱与碘化铋钾试剂可生成黄色至橘红色无定形沉淀。香豆素（A错）能发生显色反应，可用于鉴别。香豆素的显色反应：（1）异羟肟酸铁反应；（2）三氯化铁反应；（3）Gibb's反应；（4）Emerson反应。蒽醌（B错）能发生显色反应，可用于鉴别。蒽醌的显色反应有Feigl反应、Bornträger's反应、与金属离子反应等。黄酮（C错）能发生显色反应，可用于鉴别。黄酮的显色反应：黄酮类化合物的显色反应多与分子中的酚羟基及γ-吡喃酮环有关。1.还原试验：（1）盐酸-镁粉（或锌粉）反应；（2）四氢硼钠（钾）反应；2.金属盐类试剂的络合反应：（1）铝盐；（2）铅盐；（3）锆盐；（4）镁盐；（5）氯化锶；（6）三氯化铁；3.硼酸显色反应；4.碱性试剂显色反应。皂苷（D错）能发生显色反应，可用于鉴别。皂苷的显色反应：（1）Liebermann反应；（2）醋酐-浓硫酸反应；（3）三氯乙酸反应；（4）五氯化锑反应；（5）芳香醛-硫酸或高氯酸反应。